下列关于人际传播的描述不正确的是
A. 人际传播一般不需要任何非自然媒介
B. 人际传播的速度较快，信息量相对较大
C. 人际传播的交流双方可以互为传播者和受传者
D. 人际传播有益于提高传播的针对性
E. 人际传播简便易行，交流可较随意地进行

正确答案：B。人际传播的速度较快，信息量相对较大